人体阳气的根本是
A. 胃阳
B. 脾阳
C. 心阳
D. 肾阳
E. 卫阳

正确答案：D。肾阳

解析：肾阳，又称元阳、真阳、真火、命门之火，为人体阳气之本（D对）。胃阳，胃的阳气，与胃阴相对而言（A错）。脾阳是指脾的运化功能及在运化活动过程中起温煦作用的阳气，是人体阳气在脾脏功能方面的反映（B错）。心阳，心的阳气，与心阴相对而言。心阴、心阳互相依附为用。心阳是心是人体阳气的一部分（C错）。卫阳，指卫气，是人体阳气的一部分（E错）。